能叠2～3块积木的年龄是
A. 8个月
B. 10个月
C. 15个月
D. 18个月
E. 24个月

正确答案：D。18个月

解析：本题考查儿童精细动作发育规律的相关内容。精细运动是手及手指等部位小肌肉或肌肉群的运动，指较小的动作活动，如伸手够物、抓握物品、涂画、叠方积木、翻书、写字等。18月龄（D对ABCE错）能叠2～3块积木，拉脱手套或袜子；2岁儿童可叠6～7块积木，一页一页地翻书，拿住杯子喝水，模仿画垂直线和圆。